除哪项外均是霍乱患者泻吐期的临床特点
A. 多数以剧烈腹泻开始，继以呕吐
B. 多数腹泻伴有里急后重
C. 粪便以黄水便或清水便为多
D. 粪便有鱼腥味，镜检无脓细胞
E. 大便每日数次至10数次或无法计数

正确答案：B。多数腹泻伴有里急后重

解析：霍乱患者典型病例病程分为三期：泻吐期、脱水期及恢复期。其中泻吐期多数以剧烈腹泻开始，继以呕吐（A对）。腹泻是发病后的第一个症状，其特点为无发热，无里急后重（B错，为本题正确答案），大便每日数次至10数次或无法计数（E对），粪便起初含粪质，后以黄水便或清水便为多（C对），粪便有鱼腥味，镜检无脓细胞（D对）。呕吐多为喷射状，少有恶心，初呕吐物含胃内容物，后为水样，轻者可无呕吐。